第一恒磨牙的关系分为中性、近中或远中等关系。下列描述为远中的是
A. 上颌第一恒磨牙的近中颊尖咬合时与下颌第一恒磨牙的远中颊尖相对
B. 上颌第一恒磨牙的近中颊尖咬合于下颌第一、二恒磨牙之间
C. 上颌第一恒磨牙的近中颊尖咬合时咬合于下颌第一恒磨牙颊沟的近中
D. 上颌第一恒磨牙的远中颊尖咬合于下颌第二恒磨牙的近中颊沟
E. 上颌第一恒磨牙的远中颊尖咬合时与下颌第一恒磨牙远中颊尖相对

正确答案：C。上颌第一恒磨牙的近中颊尖咬合时咬合于下颌第一恒磨牙颊沟的近中

解析：本题考查牙尖交错（牙合）、前伸（牙合）及侧（牙合）。如上颌第一恒磨牙的近中颊尖咬合在下颌第一恒磨牙颊沟的近中（C对），则称为远中错（牙合），或安氏Ⅱ类错（牙合）。在牙尖交错（牙合）时，上颌第一恒磨牙的近中颊尖正对着下颌第一恒磨牙的颊沟，上颌第一恒磨牙的近中舌尖则接触在下颌第一恒磨牙的中央窝内，通常称为中性（牙合）。如上颌第一恒磨牙的近中颊尖咬合在下颌第一恒磨牙颊沟的远中，则称为近中错（牙合），或安氏Ⅲ类错（牙合）。